与全口义齿固位无关的是
A. 基托面积
B. 牙槽嵴形态
C. 黏膜性质
D. 唾液性质
E. （牙合）平衡

正确答案：E。（牙合）平衡

解析：本题考查影响全口义齿固位的有关因素。与全口义齿固位无关的是（牙合）平衡（E错，为本题的正确答案）。平衡（牙合）是指在正中咬合及下颌作前伸、侧方等非正中咬合运动时，上下颌相关的牙都能同时接触。影响全口义齿固位的有关因素：(一)颌骨的解剖形态：1.颌骨解剖形态影响基托面积：颌弓宽大，牙槽嵴（B对）高而宽，腭穹窿高而深，系带附着距离牙槽嵴顶较远，则基托面积大，固位作好。2.口腔黏膜的性质（C对）与义齿固位：黏膜的厚度适宜，有一定的弹性和韧性，则基托组织面与黏膜易于密合，边缘也易于获得良好封闭，有利于义齿固位。(二)基托的边缘伸展：基托边缘伸展范围、厚薄和形状，对于义齿的固位非常重要。在不妨碍周围组织正常活动的情况下，基托边缘应尽量伸展，以获得尽量大的基托面积（A对），并获得良好的封闭作用，以增强义齿的固位。(三)唾液的质和量（D对）：唾液的黏稠度高，流动性小，可加强义齿的固位。